支配盆腔脏器的副交感神经节前纤维起始于
A. 腰2~4节段灰质的中间带外侧
B. 骶2~4节段灰质的中间带外侧核
C. 骶2~4节段灰质的中间带内侧核
D. 迷走神经背核
E. 内上方

正确答案：B。骶2~4节段灰质的中间带外侧核

解析：支配盆腔脏器的副交感神经节前纤维起始于骶2~4节段灰质的中间带外侧核（B对）随骶神经出骶前孔，而后从骶神经分出组成盆内脏神经加入盆丛，随盆丛分支分布到盆腔脏器。